眼球壁中乳白色不透明的膜是
A. 视网膜
B. 脉络膜
C. 角膜
D. 虹膜
E. 巩膜

正确答案：E。巩膜

解析：脉络膜（B错）富含血管及色素，角膜（C错）无色透明，虹膜（D错）呈棕黑色，巩膜（E对）乳白色不透明。